蛋白质的生物学价值是表示蛋白质的
A. 蛋白质含量
B. 表观消化率
C. 真实消化率
D. 消化率
E. 生物利用率

正确答案：E。生物利用率